“水火既济”的水火指的脏是
A. 肝肾
B. 肝肺
C. 脾胃
D. 肝胆
E. 心肾

正确答案：E。心肾

解析：心位于上，五行属火，升己而降；肾居于下，五行属水，降已而升。心火下降，以资肾阳，温煦肾水（肾阴），使肾水不寒；肾水上济，以滋心阴，制约心阳，使心火不亢；心与肾的阴阳水火升降互济，维持了两脏之间生理功能的协调平衡，称为“心肾相交”，即“水火既济”（E对）。肝与肾之间的关系称为“肝肾同源”即“乙癸同源”，包括精血同源、藏泄互用以及阴阳互滋互制等方面（A错）。肝与肺的关系，主要体现在调节人体气机升降方面（B错）。脾与胃在生理上的关系，主要包括水谷纳运协调、气机升降相因、阴阳燥湿相济等（C错）。肝与胆的关系，主要表现在同司疏泄、共主勇怯等方面（D错）。